抢救由心室颤动引起的心脏骤停时，最有效的方法是
A. 静脉注射利多卡因
B. 皮下注射肾上腺素
C. 植入心脏起搏器
D. 非同步电除颤
E. 口对口人工呼吸

正确答案：D。非同步电除颤

解析：非同步电击复律（电除颤）（P208）（D对）的机制是将一定强度的电流通过心脏，使全部或大部分心肌在瞬间除极，然后心脏自律性最高的起搏点重新主导心脏节律。其是目前临床抢救心室颤动引起的心脏骤停最有效的方法。静脉注射利多卡因（A错）主要用于治疗心律失常；皮下注射肾上腺素（B错）为电除颤无效后的首选药物治疗；植入心脏起搏器（C错）一般用于有症状心动过缓患者；口对口人工呼吸（E错）虽可部分维持心脑功能，但极少能将室颤转为正常心律。